单纯性龈炎又称为
A. 牙周创伤
B. 成人牙周炎
C. 龈乳头炎
D. 青春期龈炎
E. 慢性龈炎

正确答案：E。慢性龈炎

解析：慢性龈炎是菌斑性牙龈病中最常见的疾病，又称边缘性龈炎和单纯性龈炎，临床上有一部分患者以牙龈组织的炎性肿胀为主要表现，同时伴有细胞和胶原纤维的增生，在过去曾被称之为“增生性龈炎”。掌握“慢性龈炎”知识点。